大便隐血试验阳性，提示消化道出血量在
A. 5～20mL以上
B. 30～40mL以上
C. 50～70mL以上
D. 80～100mL以上
E. 250～300mL以上

正确答案：A。5～20mL以上

解析：据研究，成人每日消化道出血＞5mL即可出现粪便隐血试验阳性（A对），每日出血量50～100mL可出现黑便（CD错），胃内蓄积血量在250～300mL可引起呕血（E错）。一次出血量＜400mL时，一般不出现全身症状；出血量400～500mL，可出现乏力、心慌等全身症状；短时间内出血量超过1000mL，可出现周围循环衰竭表现。由于周围循环衰竭是急性大出血致死的直接原因，应将周围循环状态的检查放在首要位置。